大剂量硫酸镁治疗妊娠高血压综合征最早出现的中毒反应是
A. 心率明显减慢
B. 呼吸次数明显减少
C. 血压大幅度降低
D. 尿量明显减少
E. 膝反射消失

正确答案：E。膝反射消失

解析：大剂量硫酸镁治疗妊娠高血压综合征最早出现的中毒反应是膝反射减退或消失（E对），继之出现全身肌张力减退、呼吸困难、复视、语言不清，严重者可出现呼吸肌麻痹，甚至呼吸、心跳停止，危及生命。